亚甲蓝用于解救
A. 砷盐中毒
B. 有机磷中毒
C. 铅盐中毒
D. 一氧化碳中毒
E. 氰化物中毒

正确答案：E。氰化物中毒

解析：本题考查中毒解救。亚甲蓝用于氰化物中毒（E对），小剂量可治疗高铁血红蛋白血症（亚硝酸盐中毒）。砷盐中毒（A错）解救一般选用二巯丙醇、二巯丁二钠等。有机磷中毒解救剂（B错）包括阿托品、碘解磷定、氯解磷定。铅盐中毒（C错）宜选用依地酸钙钠效果最好。一氧化碳中毒（D错）可用谷胱甘肽进行解毒，应尽快使患者脱离中毒环境，并供氧。